能够在腺体中看见大量脂肪，属于哪种腺体的特征
A. 唇腺
B. 舌下腺
C. 腭腺
D. 下颌下腺
E. 腮腺

正确答案：E。腮腺

解析：腮腺组织内常见大量脂肪，这是腮腺的特征之一。掌握“唾液腺组织学特点”知识点。